患儿，5岁。便血，新鲜，量不多，位于大便外面，考虑哪种疾病可能性大
A. 痢疾
B. 痔
C. 直肠癌
D. 直肠息肉
E. 肛周脓肿

正确答案：D。直肠息肉

解析：患儿，5岁。便血，新鲜，量不多，位于大便外面等符合直肠息肉（D对）的临床表现，如便血、大便带血、黏液血便、排便习惯改变、次数增多等，故考虑直肠息肉的可能性大。而痢疾（A错）的患儿可出现脓血黏液便，镜检有成堆脓细胞、红细胞和吞噬细胞，一般不会出现鲜血便，故该患儿不考虑此病。痔（B错）的主要表现为便血，可为无痛、间歇性、便后鲜血，便时滴血或手纸上带血，故该患儿不考虑此病。直肠癌（C错）的患儿到一定程度时出现排便习惯改变、血便、脓血便、里急后重、便秘、腹泻等，一般不会出现鲜血便，且患病年龄多为中老年人，故该患儿不考虑此病。肛周脓肿（E错）最主要症状是剧烈疼痛，且会逐渐加重，有局部坠胀和便意感，还可伴有发热等，故该患儿不考虑此病。